男性，16岁。低热、咳嗽、咽部不适2周，胸部X线片示两肺下部网状及按小叶分布的斑片状浸润阴影，血WBC10×10⁹/L。患者最可能的诊断是
A. 支原体肺炎
B. 病毒性肺炎
C. 军团菌肺炎
D. 肺炎球菌肺炎
E. 浸润型肺结核

正确答案：A。支原体肺炎

解析：患者为少年男性，低热、咳嗽、咽部不适2周，胸部X线片示两肺下部网状及按小叶分布的斑片状浸润阴影（为支原体肺炎的典型胸片改变），血WBC10×10⁹/L（正常值4～10×10⁹/L）略增高，根据其临床表现和辅助检查，可诊断为支原体肺炎（A对）。病毒性肺炎（P51）（B错）症状通常较轻，与支原体肺炎症状相似，但起病较急，发热、头痛、全身酸痛等全身症状较突出，胸部X线检查可见肺纹理增多，磨玻璃样阴影，小片状浸润或广泛浸润、实变，本例病情症状较缓慢，全身症状不突出，网状及斑片状浸润影，不符合病毒性肺炎。军团菌肺炎（C错）有高热、肌痛、相对缓脉的临床表现，X线片示下叶斑片浸润，进展迅速，无空洞，该患者低热，咽部不适，不符合军团菌肺炎的诊断。肺炎球菌肺炎（P46）（D错）多有上呼吸道感染的前驱症状，起病急骤，高热、寒战，全身肌肉酸痛等，X线有肺实变体征等，本例病无上感的前驱症状，且是低热。浸润性肺结核（E错）一般有发热盗汗等结核毒血症状，X线示病变多发生在上叶的尖后段，下叶的背段和后基底段，呈多态性，即浸润、增值、干酪、纤维钙化病变可同时存在，密度不均匀、边缘较清楚和病变变化较慢，易形成空洞和破散病灶，该患者无结核的毒血症状，且X线不符合浸润型肺结核的表现。